正确描述盆膈的是
A. 由会阴深横肌及盆膈上、下筋膜构成
B. 由肛提肌及盆膈上、下筋膜构成
C. 由肛提肌、尾骨肌及盆膈上、下筋膜构成
D. 由肛提肌及尿生殖膈构成
E. 由肛提肌、尾骨肌及盆膈下筋膜构成

正确答案：C。由肛提肌、尾骨肌及盆膈上、下筋膜构成

解析：盆膈上、下筋膜及其间的肛提肌和尾骨肌共同组成盆膈（C对）。